短效口服避孕药的主要组成成分是
A. 孕激素+雄激素
B. 雌激素
C. 孕激素
D. 雌激素+雄激素
E. 雌激素+孕激素

正确答案：E。雌激素+孕激素

解析：本题考查避孕药。短效复方口服避孕药是由雌、孕激素（E对）组成的复方制剂，其中雌激素成分主要为炔雌醇，孕激素成分则各不相同。主要避孕机制为抑制排卵，正确使用避孕药的有效率接近100%。